心电图表现为P波高尖，肢体导联P波电压>0.25mV的是
A. 左心房肥大
B. 右心房肥大
C. 左心室肥大
D. 右心室肥大
E. 双侧心室肥大

正确答案：B。右心房肥大

解析：右心房肥大的心电图特点是：①P波电压增高：在肢体导联Ⅱ、Ⅲ、aVF上P波电压≥0.25mV；在胸前导联V₁、V₂上P波电压≥0.15mV，或IPI>0.03mm·s。②P波形态高尖，在下壁导联尤为突出。③P波电轴右偏，+75°～+90°。④在QRS波群低电压的情况下，P波尖峰且振幅大于同导联R波的1/2即可诊断（B对）。左心房肥大的心电图特点是：①P波时限增宽∶P波时限≥0.12s，在Ⅰ、Ⅱ、aVL、V₄～V₆导联明显。②P波形态改变∶Ⅰ、Ⅱ、aVL、V₄～V₆导联常呈前低后高的双峰型，双峰间距≥0.04s；在V₁、V₂导联可出现以负向波为主的正负双向型P波，PtfV₁≤-0.04mm·s。③P波电轴左偏，在一30°～一45°（A错）。左心室肥大的心电图特点是：①左心室高电压∶胸导联，RV₅>2.5mV，RV₅+SV₁>4.0mV（男性）或>3.5mV（女性）；肢体导联∶R1>1.5mV，RaVL>1.2mV，RaVF>2.0mV，RⅠ+SⅢ>2.5mV。②QRS波群时间轻度延长达0.10～0.11s，但一般<0.12s，V₅导联R峰时间>0.05s。③心电轴左偏，多数≤一30°。④继发性ST-T改变：在V₅、V₆等以R波为主的导联中，ST段下移>0.05mV，T波低平、双向或倒置（C错）。右心室肥大的心电图特点是：①QRS波群电压增高∶RV₁>1.0mV，RV₁+SV₅>1.05mV（重症>1.2mV，RaVR>0.5mV。②QRS波群形态改变：V₁导联的R波电压增高，呈RS、R型，R/S>1，重度右心室肥大时V₁可呈qR型（除外心肌梗死），V₅导联S波加深，R/S<1。aVR导联以R波为主，R/Q>1或R/S>1。③心电轴右偏≥+90°，重者>+110°。④继发性ST-T改变：V₁、V₂等右胸导联ST段下移>0.05mV，T波低平、双向或倒置。⑤V₁导联R峰时间>0.04s，但QRS波群时间并不延长（D错）。双侧心室肥大，在诊断左心室肥大的基础上，具有下列一项或几项：①QRS心电轴右偏。②V₁有高R波，R/S>1。③RaVR>0.5mV并除外左前分支阻滞。④V₅、V₆导联深S波。另外，如心电图存在右心房异常，往往是合并右心室肥大的线索。②在诊断右室肥大的基础上，具有下列一项或几项：①QRS电轴左偏。②V₅、V₆导联出现高R波，R峰时间延长，ST段下降及T波倒置。③V₃导联R十S>6.0mV，R波与S波振幅大致相等（E错）。